测定醋酸地塞米松注射液含量的方法是
A. 分子排阻色潽法
B. 四氮唑比色法
C. 抗生素微生物法
D. 氧瓶燃烧比色法
E. 红外分光光度法

正确答案：B。四氮唑比色法

解析：本题考查醋酸地塞米松注射液的含量测定方法。皮质激素类药物的C₁₇-α-醇酮基有还原性，可以定量还原四氮唑盐生成有色甲嗜，四氮唑比色法可用于皮质激素类药物的含量测定。目前多数甾体激素类药物已改用高效液相色谱法测定，仅有少数品种制剂如醋酸去氧皮质酮、醋酸地塞米松注射液等采用
比色法（B对）测定。